符合左心房肥大心电图特点的是
A. P波时间=0.15s
B. P波时间=0.10s
C. Ⅰ导联P波振幅=0.1mV
D. aVL导联P波振幅=0.22mV
E. Ⅱ导联P波振幅=0.3mV

正确答案：A。P波时间=0.15s

解析：左心房肥大的心电图特点是：①P波时限增宽∶P波时限≥0.12s（A对B错），在Ⅰ、Ⅱ、aVL、V₄～V₆导联明显（CDE错）。②P波形态改变∶Ⅰ、Ⅱ、aVL、V₄～V₆导联常呈前低后高的双峰型，双峰间距≥0.04s；在V₁、V₂导联可出现以负向波为主的正负双向型P波，PtfV₁≤-0.04mm·s。③P波电轴左偏，在-30°～-45°。